属于配体门控的离子通道受体的是
A. 胰岛素受体
B. 甲状腺激素受体
C. β受体
D. N受体
E. 表皮生长因子受体

正确答案：D。N受体

解析：本题考查受体的类型。配体门控离子通道受体由配体结合部位及离子通道两部分构成，当配体与其结合后，受体变构使通道开放或关闭，改变细胞膜离子流动状态，从而传递信息。这一类受体包括N型乙酰胆碱受体（D对）、γ-氨基丁酸（GABA）受体等。